女，28岁，妊娠38周。B超示胎儿脐带绕颈2周，拟行剖宫产术。4年前曾因外伤住院，接受输血后出现严重过敏反应。孕妇一般状况良好，心、肝、肾功能正常。化验Hb100g/L。术前拟申请备血400ml，应选择的血液成分是
A. 冷沉淀
B. 洗涤红细胞
C. 新鲜冰冻血浆
D. 悬浮红细胞
E. 浓缩血小板

正确答案：B。洗涤红细胞

解析：患者曾出现过严重过敏反应，过敏反应是由血浆中蛋白类物质、免疫球蛋白及白细胞携带的某些抗体引发，为避免再次过敏反应，再次输血时应选择去除了大部分血浆及白细胞的洗涤红细胞（B对）。冷沉淀（A错）、新鲜冰冻血浆（C错）均属血浆制品，主要用于补充凝血因子。悬浮红细胞（D错）指将全血中绝大部分血浆分离出后，加入红细胞添加液制成，其中含有白细胞，可能再次发生过敏反应。浓缩血小板（E错）主要用于补充血小板，不用于术中补充血容量。